以下哪项不是缩宫素的特点
A. 能直接兴奋子宫平滑肌
B. 对子宫体兴奋作用强
C. 对子宫颈有松弛作用
D. 对子宫作用敏感性不受女性激素的影响
E. 大剂量引起子宫平滑肌强直性收缩

正确答案：D。对子宫作用敏感性不受女性激素的影响

解析：本题考查缩宫素的特点。子宫对缩宫素的敏感性与体内雌、孕激素水平密切相关。（D错，为本题正确答案）不属于缩宫素的特点。缩宫素选择性兴奋子宫平滑肌（A对），对子宫体兴奋作用强（B对），使子宫颈平滑肌松弛（C对），这种收缩性质与正常分娩相似。大剂量可引起子宫平滑肌强直性收缩（E对）。